瓷全冠的优点不包括下列哪一项
A. 色泽稳定自然
B. 导热低
C. 生物相容性好
D. 不导电
E. 脆性小，强度高

正确答案：E。脆性小，强度高

解析：本题考查全瓷冠的优点。瓷全冠的优点不包括脆性小，强度高（E错，为本题的正确答案）。作为一种永久性修复体，瓷全冠也应具有较高的强度及韧性，但全瓷材料相对于金属等材料脆性较大。瓷全冠是以陶瓷材料制成的覆盖整个牙冠表面的修复体，具有与天然牙相似的美学效果，色泽稳定自然（A对）。陶瓷材料具有导热低（B对）的特点，热导率为1.05单位，而金属材料如金的热导率为297单位。不仅如此，陶瓷相对于金属具有更好的生物相容性（C对）以及不导电性（D对），有利于保护口腔组织的健康。